腰痛寒湿腰痛证，其中医治法是
A. 散寒行湿，发汗解表
B. 清热利湿，利水通淋
C. 活血化瘀，理气止痛
D. 清热利湿，舒筋止痛
E. 散寒行湿，温经通络

正确答案：E。散寒行湿，温经通络

解析：寒湿邪气侵袭腰部，筋脉拘急，气血阻滞不通：风寒湿邪为患，侵袭腰部，痹阻经络，因寒性收引，湿性凝滞，故见冷痛重着，转侧不利、酸麻，或拘急不可俯仰。腰部经脉为风寒之邪阻滞，故见痛连骶、臀、股、腘。湿为阴邪，得阳运始化，静卧则湿邪更易停滞，故虽卧疼痛不减。阴雨寒冷天气则寒湿更甚，故疼痛加剧，治以散寒祛湿，温经通络（E对）。活血化瘀，理气止痛是瘀血腰痛的治疗原则（C错）。清热利湿，舒筋止痛是湿热腰痛的治疗原则（D错）。